眶下间隙的内界是
A. 鼻侧缘
B. 眶下缘
C. 颧肌
D. 咬肌前缘
E. 上颌骨牙槽突

正确答案：A。鼻侧缘

解析：眶下间隙位于眼眶前部的下方。上界为眶下缘，下界为上颌骨牙槽突，内界为鼻侧缘，外以颧肌为界。掌握“面侧深区及颌面部各间隙的境界”知识点。